因影响细胞内Ca²⁺的稳态而导致各种心律失常不良反应的药物是
A. 多柔比星
B. 索他洛尔
C. 普鲁卡因胺
D. 肾上腺素
E. 强心苷

正确答案：E。强心苷

解析：本题考查强心苷。因影响细胞内Ca²⁺的稳态而导致各种心律失常不良反应的药物是强心苷（E对）。强心苷引起Ca²⁺浓度的增高和K⁺浓度降低是其导致各种心律失常的主要原因；多柔比星（A错）可能通过氧自由基的途径对心脏产生毒性；索他洛尔（B错）能够阻断与复极化过程有关的K⁺通道，抑制K⁺外流，或增加内向电流如Na⁺和Ca²⁺内流，可导致心电图Q-T间期延长，引起尖端扭转型室性心律失常；普鲁卡因胺（C错）对心脏的影响包括降低自律性、减慢传导和延长有效不应期等；肾上腺素（D错）激动心脏β₂受体使冠脉扩张，心肌代谢产物增加，具有诱发心绞痛的潜在毒性。